某女，28岁。妊娠3个月。走路时不小心崴脚，导致右脚踝肿胀、疼痛，来药店购药。根据《中国药典》，孕妇禁用的中成药是
A. 跌打镇痛膏
B. 麝香镇痛膏
C. 伤湿止痛膏
D. 活血止痛膏
E. 少林风湿跌打膏

正确答案：B。麝香镇痛膏

解析：本题考查妊娠禁用、忌用与慎用的中成药。根据《中国药典》，孕妇禁用的中成药是麝香镇痛膏（B对）。妊娠禁用、忌用与慎用的中成药：与单味中药一样，有些中成药也会损伤胎儿及母体，妊娠妇女应当有所避忌。一般分为妊娠禁用、忌用与慎用。《中国药典》收载的妊娠禁用、忌用的主要品种有：二十七味定坤丸、十一味能消丸、麝香镇痛膏、蠲哮片等。《中国药典》收载的妊娠慎用的主要品种有：十香止痛丸、三妙丸、三黄片、跌打镇痛膏（A错）、伤湿止痛膏（C错）、活血止痛膏（D错）、少林风湿跌打膏（E错）等。